女，2岁，喂养困难，气促多汗生长落后，查体：双肺呼吸音粗，律齐，胸骨左缘第二肋间可闻及响亮的粗糙机器音，心电图示：左室肥厚，最可能的诊断是
A. 动脉导管未闭
B. 房间隔缺损
C. 室间隔缺损
D. 法洛四联症
E. 肺动脉狭窄

正确答案：A。动脉导管未闭

解析：喂养困难，气促多汗生长落后（动脉导管未闭的临床表现）；双肺呼吸音粗，律齐，胸骨左缘第二肋间可闻及响亮的粗糙机器音（动脉导管未闭的体征）；左室肥厚（符合动脉导管未闭的心电图表现）（A对）。